起效缓慢，可增加心力衰竭和女性骨折风险的口服抗糖尿病药物是
A. 艾塞那肽
B. 利拉鲁肽
C. 西格列汀
D. 罗格列酮
E. 瑞格列奈

正确答案：D。罗格列酮

解析：本题考查罗格列酮。起效缓慢，可增加心力衰竭和女性骨折风险的口服抗糖尿病药物是罗格列酮（D对）。利拉鲁肽（B错）常见不良反应有恶心、腹泻、呕吐、便秘、腹痛、消化不良、头痛和上呼吸道感染等。西格列汀（C错）不良反应有过敏反应、血管性水肿、皮疹、荨麻疹、皮肤血管炎以及剥脱性皮肤损害等。瑞格列奈（E错）不良反应有腹痛、腹泻、低血糖等。